心纤维性支架不包括以下哪个结构
A. 二尖瓣环
B. 左纤维三角
C. 圆锥韧带
D. 隔缘肉柱
E. 中心纤维体

正确答案：D。隔缘肉柱

解析：二尖瓣环（A对）、左纤维三角（B对）、圆锥韧带（C对）、中心纤维体（E对）均为心纤维性支架的组成结构。隔缘肉柱（D错，为本题正确答案）不是参与心纤维性支架的组成结构。